女，35岁。脸圆脸红向心性肥胖1年余。患者感明显的乏力与口干，腹部皮肤可见紫纹，皮肤薄，血压160/80mmHg，闭经1年。对定性诊断足有帮助的试验
A. 24小时游离皮质醇测定
B. 大剂量地塞米松抑制试验
C. 小剂量地塞米松抑制试验
D. 早晨8点血皮质醇检测
E. 下午4点血皮质醇水平检测

正确答案：C。小剂量地塞米松抑制试验

解析：青年女性患者，向心性肥胖、腹部皮肤可见紫纹、皮肤薄、血压增高、闭经，为典型库欣综合征的表现，库欣综合征为各种病因造成肾上腺分泌过多糖皮质激素所致病症的总称。其血浆皮质醇分泌增多，失去昼夜节律，且不能被小剂量地塞米松抑制（P701）。地塞米松为人工合成的糖皮质激素中生物作用最强的激素之一，仅需要很小的剂量即能达到与天然皮质醇相似的作用，使用小剂量地塞米松可抑制正常人的皮质醇分泌，从而血皮质醇测定值减少，而库欣综合征却不受影响。因此小剂量地塞米松抑制试验（C对）可以用于库欣综合征的定性诊断。大剂量地塞米松抑制试验（B错）主要用于确诊库欣综合征后不同病因的鉴别诊断。24小时游离皮质醇（A错）、早8点血皮质醇（D错）、下午4点血皮质醇水平（E错）异常亦可见于其他引起血糖皮质激素增多的疾病。